决定和影响传导性的主要因素是
A. 0期去极速度和幅度
B. 4期自动去极速度
C. 阈电位水平
D. 最大复极电位水平
E. 平台期时程

正确答案：A。0期去极速度和幅度